关于重度妊高征的治疗，下列哪项不适宜
A. 解痉，镇静，防止抽搐
B. 在解痉的基础上，扩容利尿
C. 适时终止妊娠
D. 严格控制钠盐摄入量，防止水肿加重
E. 扩容剂的选择，胶体溶液优于晶体溶液

正确答案：D。严格控制钠盐摄入量，防止水肿加重

解析：妊娠高血压疾病的饮食原则是：应包括充足的蛋白质、热量，不限盐和液体，但对于全身水肿者应适当限制盐的摄入。故选项D不适宜。掌握“娠期高血压疾病”知识点。